男，35岁。机器碾压致腕部、手部受伤，手掌部皮肤严重缺损，肌腱外露，手指均不能屈曲，感觉消失，第2～3掌骨骨折。不正确的处理是
A. 在止血带下清创
B. 行皮瓣移植术
C. 肌腱神经损伤必须同时行一期修复
D. 影响血供的血管损伤应立即修复
E. 骨折必须复位固定

正确答案：C。肌腱神经损伤必须同时行一期修复

解析：患者肌腱外露，手指均不能屈曲，提示患者手部屈肌腱损伤。肌腱是关节活动的传动装置，损伤将严重影响手的功能，损伤后均应一期修复。手部开放性神经断裂，尽量在清创时一期修复，若创口损伤严重或合并皮肤缺损，可先将神经两端的外膜固定于周围组织，然后二期修复（C错，为本题正确答案）。手外伤后应争取在伤后6～8小时内彻底清创。清创应在良好的麻醉和气囊止血带控制下进行，从浅到深层，按顺序进行，以防漏诊（A对）。影响手部血液循环的血管损伤应立即修复（D对）。掌指骨骨折多为开放性损伤，无论创口情况和损伤严重程度如何，均应及时复位固定（E对）。皮肤裂伤，可直接缝合，对于有神经、肌腱、骨关节外露者均应行皮瓣移植术（B对）。